谷粒中含硫胺素最高的部位是
A. 胚乳
B. 糊粉层
C. 谷皮
D. 全谷粒
E. 胚

正确答案：E。胚